阻止肝脏氢醌型维生素K生成的抗凝血药是
A. 肝素
B. 链激酶
C. 双嘧达莫
D. 华法林
E. 噻氯匹定

正确答案：D。华法林

解析：本题考查华法林。华法林（D对）可阻止肝脏氢醌型维生素K生成。华法林可竞争性抑制维生素K环氧化物还原酶，抑制氢醌型维生素K合成。肝素（A错）通过激活抗凝血酶Ⅲ发挥作用。链激酶（B错）是血栓溶解药。双嘧达莫（C错）作用机制为抗血小板聚集。噻氯匹定（E错）通过抑制血小板聚集发挥作用。